患者男性，56岁，患有胃溃疡病10年。现胃痛隐隐，喜温喜按，畏寒肢冷，泛吐清水，腹胀便溏，舌淡胖边有齿痕，苔白，脉迟缓。治疗方剂是
A. 暖肝煎合左金丸
B. 活络效灵丹合丹参饮
C. 黄芪建中汤
D. 一贯煎合芍药甘草汤
E. 柴胡疏肝散合五磨饮子

正确答案：C。黄芪建中汤

解析：胃痛隐隐，喜温喜按表明为虚证，畏寒肢冷，泛吐清水，脉迟缓为寒证，根据患者表现为脾胃虚寒证，当以温中健脾，和胃止痛，方用黄芪建中汤（C对）。暖肝煎合左金丸适温补肝肾，行气止痛（A错）。活络效灵丹合丹参饮主治瘀血停胃证（B错）。柴胡疏肝散合五磨饮子主治肝胃不和证（E错）。